患者痫证发作时昏仆抽搐，吐涎，平时情绪急躁，心烦失眠，咳痰不爽，口苦且干，大便秘结，舌红，苔黄厚腻，治宜选用
A. 礞石滚痰丸
B. 当归芦荟丸
C. 牛黄清心丸
D. 更衣丸
E. 竹沥达痰丸

正确答案：E。竹沥达痰丸

解析：肝火偏旺，火动生风，煎熬津液，结而为痰，风动痰升，阻塞心窍，故而痫证发作时昏仆抽搐，吐涎；肝气不舒则平时情绪急躁，火扰心神而见心烦失眠，咳痰不爽，口苦且干，大便秘结；舌红，苔黄厚腻，均为痰火壅实之侯，可用竹沥达痰丸以祛痰泻火通腑（E对）。礞石滚痰丸（A错）降火逐痰，治疗痰火扰心所致的癫狂惊悸，或喘咳痰稠，大便秘结。牛黄清心丸（C错）清心化痰，镇惊祛风，适用于心火亢盛，痰热内蕴证。更衣丸（D错）泻火，通便，安神，用于治疗肝火上炎，肠热便秘，目赤易怒。竹沥达痰丸（E错）豁除顽痰，清火顺气，适用于咳喘痰多，大便干燥，烦闷癫狂等症。